适合于制成溶液型注射剂
A. 水中难溶且稳定的药物
B. 水中易溶且稳定的药物
C. 油中易溶且稳定的药物
D. 水中易溶且不稳定的药物
E. 油中不溶且不稳定的药物

正确答案：B。水中易溶且稳定的药物